“异病同治”的依据是
A. 病因相同
B. 病种相同
C. 病邪相同
D. 病机相同
E. 某一症状相同

正确答案：D。病机相同

解析：本题考查的是异病同治的概念。“异病同治”的依据是病机相同（D对）。“异病同治”，则是指不同的疾病，在其发展过程中，由于出现了相同的病机，因而也可以采用同一种方法来治疗。